尿道舟状窝位于
A. 尿道前列腺部
B. 尿道膜部
C. 尿道海绵体部
D. 尿道球部
E. 阴茎头部的尿道

正确答案：E。阴茎头部的尿道

解析：阴茎头部的尿道（E对）扩大为尿道舟状窝。